属于自身免疫性疾病的是
A. 艾滋病
B. 系统性红班狼疮
C. 青霉素过敏
D. 白血病
E. 接触性皮炎

正确答案：B。系统性红班狼疮